宜用米汤作药引的中成药有
A. 四神丸
B. 更衣丸
C. 附子理中丸
D. 独活寄生丸
E. 人参养荣丸

正确答案：A、B、E。四神丸；更衣丸；人参养荣丸

解析：本题考查中成药与药引的配伍应用。宜选用米汤送服的是四神丸（A对）、更衣丸（B对）、人参养荣丸（E对）。米汤具有温养脾胃、顾护胃气的功效，还可减少药物对肠胃的刺激，因此凡脾胃虚弱，素有胃肠道疾患的患者服用更衣丸、麻仁丸、消渴丸、四神丸等，以及服用治疗身体衰弱的补益类中成药如十全大补丸、人参养荣丸等，宜用米汤送服，小米、大米汤汁均可。如对外感风寒或脾胃虚寒之呕吐泄泻等病证，常用生姜、大枣煎汤送服中成药，如治风寒表实咳嗽的通宣理肺丸、温中散寒的附子理中丸（C错）、和中解表的藿香正气水等。对于跌打损伤、风寒湿痹等证，常用黄酒或白酒送服三七粉、云南白药、三七伤药片、七厘散、大活络丸、再造丸、醒消丸、跌打丸、独活寄生丸（D错）、腰痛宁胶囊等。